脊髓丘脑束传导
A. 意识性本体觉
B. 精细触觉
C. 平衡觉
D. 听觉
E. 痛温觉

正确答案：E。痛温觉

解析：脊髓丘脑束：分为脊髓丘脑侧束和脊髓丘脑前束，脊髓丘脑侧束位于外侧索的前半部，并与其邻近的纤维束有重叠，主要传递痛、温觉（E对）信息。脊髓丘脑前束位于前索，前根纤维的内侧，主要传递粗触觉、压觉信息。